对损伤或残疾进行补偿的医疗器械是
A. 心电图机
B. 避孕器具
C. 手动轮椅
D. 手术器械
E. 心脏瓣膜

正确答案：C。手动轮椅